条件反射测定属于学习疲劳评价方法中的
A. 体征与行为观察法
B. 教育心理学方法
C. 生理学方法
D. 生理-教育心理结合法
E. 社会心理学方法

正确答案：C。生理学方法